抗室上性心律失常伴冠心病
A. 苯妥英钠
B. 胺碘酮
C. 维拉帕米
D. 地高辛
E. 普罗帕酮

正确答案：C。维拉帕米